石膏的主成分是
A. Na₂SO₄·10H₂O
B. CaSO₄·2H₂O
C. ZnCO₃
D. HgS
E. FeS₃

正确答案：B。CaSO₄·2H₂O

解析：本题考查的是石膏的来源。石膏的主成分是CaSO₄·2H₂O（B对）。石膏：【来源】为硫酸盐类矿物硬石膏族石膏。主含含水硫酸钙（CaSO₄·2H₂O）。含Na₂SO₄·10H₂O（A错）的中药为芒硝。芒硝：【来源】为硫酸盐类矿物芒硝族芒硝，经加工精制而成的结晶体。主含含水硫酸钠（Na₂SO₄·10H₂O）。含ZnCO₃（C错）的中药为炉甘石。炉甘石：【来源】为碳酸盐类矿物方解石族菱锌矿。主含碳酸锌（ZnCO₃）。含HgS（D错）的中药为朱砂。朱砂：【来源】为硫化物类矿物辰砂族辰砂。主含硫化汞（HgS）。含FeS₃（E错）的中药，2022年考试指南未明确说明。